利多卡因的叙述正确的是
A. 对室上性心律失常有效
B. 可口服，也可静脉注射
C. 肝脏代谢少，主要以原形经肾排泄
D. 属于Ⅰc类抗心律失常药
E. 为急性心肌梗死引起的室性心律失常的首选药

正确答案：E。为急性心肌梗死引起的室性心律失常的首选药

解析：本题考查利多卡因。利多卡因为急性心肌梗死引起的室性心律失常的首选药（E对），且仅用于室性心律失常（A错）。利多卡因为Ⅰb类抗心律失常药（D错），口服生物利用度低（B错），肌注后吸收完全，90%经肝脏代谢（C错）。